同源脱敏表现为
A. 长期使用一种受体的激动药后，该受体对激动药的敏感性下降
B. 长期使用一种受体的激动药后，该受体对激动药的敏感性增强
C. 长期使用受体拮抗药后，受体数量或受体对激动药的敏感性增加
D. 受体对一种类型受体的激动药反应下降，对其他类型受体激动药的反应也不敏感
E. 受体只对一种类型的激动药的反应下降，而对其他类型受体激动药的反应不变

正确答案：E。受体只对一种类型的激动药的反应下降，而对其他类型受体激动药的反应不变

解析：本题考查作用于受体药物的分类。同源脱敏表现为受体只对一种类型的激动药的反应下降，而对其他类型受体激动药的反应不变（E对）。同源脱敏是指只对一种类型的受体激动药的反应下降，而对其他类型受体激动药的反应性不变，因此又称特异性脱敏。长期使用一种受体的激动药后，该受体对激动药的敏感性下降（A错）的是受体脱敏。长期使用受体拮抗药后，受体数量或受体对激动药的敏感性增加（C错）的是受体增敏。受体对一种类型受体的激动药反应下降，对其他类型受体激动药的反应也不敏感（D错）的是异源脱敏。